人工被动免疫效果为
A. 2～4周
B. 2～3周
C. 2～5周
D. 1～2周
E. 1～3周

正确答案：B。2～3周